我国居民膳食中膳食纤维的重要来源
A. 肉类
B. 蛋类
C. 奶制品
D. 精制米面
E. 水果蔬菜

正确答案：E。水果蔬菜